既补中益气，又养血安神的药是
A. 大枣
B. 沙苑子
C. 骨碎补
D. 太子参
E. 玉竹

正确答案：A。大枣

解析：本题考查的是大枣的功效。既补中益气，又养血安神的药是大枣（A对）。大枣：【功效】补中益气，养血安神，缓和药性。沙苑子（B错）：【功效】补肾固精，养肝明目。骨碎补（C错）：【功效】补肾，活血，止痛，续伤。太子参（D错）：【功效】补气生津。玉竹（E错）：【功效】滋阴润肺，生津养胃。